桑叶的功效有
A. 疏散风热
B. 清肺润燥
C. 息风止痉
D. 平肝明目
E. 凉血止血

正确答案：A、B、D、E。疏散风热；清肺润燥；平肝明目；凉血止血

解析：本题考查的是桑叶的功效。桑叶的功效有疏散风热（A对）、清肺润燥（B对）、平肝明目（D对）与凉血止血（E对）。桑叶：【功效】疏散风热，清肺润燥，平肝明目，凉血止血。蝉蜕：【功效】疏散风热，透疹止痒，明目退翳，息风止痉（C错）。